下列哪项内脏神经的描述是错误的
A. 含内脏运动和内脏感觉纤维
B. 内脏运动神经分交感神经和副交感神经
C. 交感神经和副交感神经都有其独立中枢部和周围部
D. 脑和脊神经节内有内脏神经元的胞体
E. 交感神经和副交感神经由低级中枢到所支配器官均需换神经元

正确答案：E。交感神经和副交感神经由低级中枢到所支配器官均需换神经元

解析：内脏神经按照纤维的性质可分为感觉性和运动性两种（A对）。根据形态、功能和药理学的特点，内脏运动神经分为交感神经和副交感神经两部分（B对）。交感神经的低级中枢位于脊髓Tl-L3节段的灰质侧柱的中间外侧核，周围部包括交感干、交感神经节，以及由节发出的分支和交感神经丛等，副交感神经的低级中枢位于脑干的一般内脏运动核和脊髓骶部第2-4节段灰质的骶副交感核，周围部的副交感神经节，位于器官的周围或器官的壁内，称器官旁节和器官内节（C对）。内脏感觉神经如同躯体感觉神经，其初级感觉神经元胞体也位于感觉性脑神经节和脊神经节内，周围突则分布于内脏和心血管等器官的内感受器，把感受到的刺激传递到各级中枢，也可到达大脑皮质（D对）。交感神经支配的肾上腺髓质不交换神经元（E错，为本题正确选项）。